烧伤面积的计算按中国九分法，双上肢面积占
A. 9%
B. 18%
C. 27%
D. 36%
E. 45%

正确答案：B。18%

解析：该题考查烧伤的面积计算。中国九分法：将全身体表面积分为11个9等份。成人头、面、颈部为9%（A错）；双上肢为2×9%（B对）；躯干前后包括外阴部为3×9%（C错）；双下肢包括臀部为5×9%+1%=46%。头或面或颈部加躯干前后包括外阴部为36%，双上肢加头面或头颈或面颈部为36%（D错）。头面颈部加双上肢为45%，躯干前后包括外阴部加头面或头颈或面颈部为45%（E错）。